哪类降压药兼有改善肾功能、心功能，逆转心脏肥大，并能明显降低病死率
A. 可乐定等中枢性降压药
B. 钙离子通道阻滞药
C. 血管紧张素转换酶抑制药
D. 利尿降压药
E. 神经节阻断药

正确答案：C。血管紧张素转换酶抑制药